哮喘发作时的典型体征是
A. 广泛哮鸣音，呼气音延长
B. 吸气音延长
C. 呼吸音减低
D. 胸膜摩擦音
E. 双肺干啰音

正确答案：A。广泛哮鸣音，呼气音延长

解析：支气管哮喘发作时气道接触反应性炎症刺激，出现过强或过早的收缩反应，当气流通过气道时，气流受限，形成广泛哮鸣音，呼气音延长（A对）。